暑淫证候的表现是
A. 头昏沉，嗜睡，胸脘痞闷
B. 口渴饮水，口唇鼻咽干燥
C. 发热恶热，汗出，气短神疲
D. 突发皮肤瘙痒、丘疹
E. 肠鸣腹泻，脘腹拘急冷痛

正确答案：C。发热恶热，汗出，气短神疲

解析：本题考查暑邪的临床表现，属于理解记忆内容。暑为阳邪，其性升散，易耗气伤津，故临床除见口渴喜饮、尿赤短少等津伤之症外，往往可见气短、乏力，甚则气津耗伤太过，清窍失养而突然昏倒、不省人事。又因为暑多兼湿，所以其临床表现除发热、烦渴等暑热症状外，常兼见身热不扬、四肢困倦、胸闷呕恶、大便溏泄不爽等湿滞症状。综上，发热恶热，汗出，气短神疲符合暑邪的临床表现（C对）。头昏沉，嗜睡，胸脘痞闷符合湿邪的临床表现（A错）。口唇鼻咽干燥为燥邪的临床表现（B错）。突发皮肤瘙痒、丘疹符合风邪临床表现（D错）。肠鸣腹泻，脘腹拘急冷痛符合寒邪的临床表现（E错）。